具有高级专业技术职务任职资格的医师授予处方权的司帕沙星属于
A. 非限制级抗菌药物
B. 重点监测级抗菌药物
C. 特殊使用级抗菌药物
D. 限制级抗菌药物

正确答案：C。特殊使用级抗菌药物

解析：本题考查的是抗菌药物处方权、调剂资格的授予。具有高级专业技术职务任职资格的医师授予处方权的司帕沙星属于特殊使用级抗菌药物（C对）。抗菌药物处方权、调剂资格的授予：具有高级专业技术职务任职资格的医师，可授予特殊使用级抗菌药物处方权；具有中级以上专业技术职务任职资格的医师，可授予限制使用级抗菌药物（D错）处方权；具有初级专业技术职务任职资格的医师，在乡、民族乡、镇、村的医疗机构独立从事一般执业活动的执业助理医师以及乡村医生，可授予非限制使用级抗菌药物（A错）处方权。药师经培训并考核合格后，方可获得抗菌药物调剂资格。二级以上医院应当定期对医师和药师进行抗菌药物临床应用知识和规范化管理的培训。医师经本医疗机构培训并考核合格后，方可获得相应的处方权。其他医疗机构依法享有处方权的医师、乡村医生和从事处方调剂工作的药师，由县级以上地方卫生行政部门组织相关培训、考核。经考核合格的，授予相应的抗菌药物处方权或者抗菌药物调剂资格。